60岁，女性。原发不育、绝经6年，高血压史，不规则阴道少量流血2天。妇科检查：除子宫增大如妊娠6周外，余均正常。确诊方法应是
A. B型超声检查
B. 血清CA125测定
C. 盆腔磁共振成像
D. 细胞学检查
E. 分段诊刮

正确答案：E。分段诊刮

解析：该患者为老年女性，原发不育（子宫内膜癌的高危因素包括肥胖、不育、绝境延迟等），有高血压病史，绝经后不规则阴道少量流血（主要临床表现为绝经后阴道流血），妇检：子宫增大（晚期可有子宫明显增大），考虑子宫内膜癌。确诊方法是分段诊刮（E对），其能刮取子宫内膜和内膜病灶行活组织检查，作出病理检查。B型超声检查（P315）（A错）能够了解子宫内膜厚度、肌层有无浸润，对异常阴道流血作出初步判断并为进一步的检查选择提供参考，不作为确诊手段。血清CA125测定（P316）（B错）在有子宫外转移者会升高，也可作为疗效观察指标，仍需病理组织学检查进行确诊。盆腔磁共振成像（P316）（C错）对肌层浸润深度和宫颈间质浸润有较准确的判断，但不能确诊。细胞学检查（P404）（D错）适用于恶性肿瘤的初步筛选，不作为确诊依据。